可疑神经管缺陷的羊水过多孕妇，最常应用的检测方法是
A. 血hCG值
B. 血胎盘生乳素值
C. 血雌三醇值
D. 血甲胎蛋白值
E. 羊水卵磷脂/鞘磷脂比值

正确答案：D。血甲胎蛋白值

解析：由于90％神经管缺陷孕妇的血清和羊水中的AFP水平升高，故可疑神经管缺陷的羊水过多孕妇，最常应用的检测方法是血甲胎蛋白值（D对）。血hCG值用于诊断早早孕（P42）（A错）。血胎盘生乳素值（P152）（B错）、血雌三醇值（P152）（C错）主要用于评估胎儿的胎盘功能。羊水卵磷脂/鞘磷脂比值（P153）（E错）用于判断胎儿肺是否成熟。